妊娠合并心脏病的孕妇死亡的主要原因是
A. 心脏病病程长
B. 未经产前检查
C. 孕妇年龄大
D. 心衰与感染
E. 孕周过大

正确答案：D。心衰与感染

解析：妊娠合并心脏病的孕妇死亡的主要原因是心衰与感染，妊娠、分娩及产褥期均可能使心脏病患者的心脏负担加重而诱发心力衰竭，是孕产妇死亡的重要原因之一感染导致心功能严重受累者，妊娠期发生心力衰竭的危险性很大（D对）。心脏病病程长者，孕期极易发生心力衰竭，不宜妊娠（A错）。系统的产前检查，可尽早筛查出具有高危因素的孕妇，及早给予评估与诊治，不断提高高危妊娠随诊率、检出率、住院分娩率，降低孕产妇死亡率、围生儿死亡率和病残儿出生率（B错）。孕妇年龄大易发生妊娠期肝内胆汁淤积症（C错）。孕周过大，胎儿对营养物质的需求量增加，孕妇对胰岛素的敏感性可随孕周增加而下降，故相应增加了对胰岛素的需求。部分孕妇由于胰岛素分泌受限，不能代偿这一生理变化而使血糖升高，使原有糖尿病加重或出现妊娠期糖尿病（E错）。